肱骨中段骨折，最容易损伤的神经是
A. 尺神经
B. 桡神经
C. 正中神经
D. 肌皮神经
E. 腋神经

正确答案：B。桡神经

解析：桡神经发自臂丛后束，在肱骨中段经肱骨桡神经沟转至臂外侧，故肱骨中段骨折时，最容易损伤的神经为桡神经（B对）。尺神经（A错）损伤多见于腕部和肘部切割伤。正中神经（C错）损伤常由儿童肱骨髁上骨折和腕部切割伤引起。肌皮神经（D错）损伤主要见于肱骨上段骨折。腋神经损伤（E错）多见于肱骨外科颈骨折。